属前体药物，含酮酸结构
A. 舒林酸
B. 萘丁美酮
C. 芬布芬
D. 吡罗昔康
E. 别嘌醇

正确答案：C。芬布芬